按照《药品说明书规范细则（暂行）》，药品说明书【药理毒理】项目内容中的非临床毒理研究内容一般包括
A. 致癌性
B. 生殖毒性
C. 长期毒性
D. 遗传毒性
E. 急性毒性

正确答案：A、B、C、D、E。致癌性；生殖毒性；长期毒性；遗传毒性；急性毒性